射干不具有的功效是
A. 清热
B. 散结
C. 祛痰
D. 利尿
E. 得咽

正确答案：D。利尿

解析：本题考查射干的功效。射干不具有的功效是利尿（D错，为本题正确答案）。射干【功效】清热（A对）解毒，祛痰（C对）利咽（E对），散结（B对）消肿。